治疗感染性休克时，纠正血容量不足的最适宜输液方案是
A. 以平衡盐溶液为主，配合适量血浆或全血
B. 以胶体溶液（如代血浆）为主
C. 以等渗生理盐水和代血浆为主
D. 以等渗葡萄糖溶液和代血浆为主
E. 以全血配合等渗葡萄糖溶液

正确答案：A。以平衡盐溶液为主，配合适量血浆或全血

解析：感染性休克纠正血容量不足时，首先以输注平衡盐溶液（各种离子及其含量与血浆相近）为主，配合适当的胶体液、血浆或全血（A对），可迅速恢复足够的循环血量。输注晶体液既能补充血容量，又能有效纠正电解质紊乱，而胶体液、等渗葡萄糖溶液只能增加血容量，故补液时应以晶体液为主，后输胶体液（B错），先输盐溶液，后输葡萄糖溶液（D错）。等渗生理盐水（C错）渗透压及钠含量与血浆相似，但氯离子含量过高，大量输注易引发高氯性酸中毒。全血中成分较多，易发生输血反应、造成浪费（E错），现已极少应用。需注意：外科补液原则为先晶体后胶体，先盐后糖，先快后慢，见尿补钾。